以热气体传递热能，使物料中的水分气化并被气流带走的干燥方法是
A. 真空干燥
B. 对流干燥
C. 辐射干燥
D. 介电加热干燥
E. 传导干燥

正确答案：B。对流干燥